被称为“罢极之本”的是
A. 心
B. 脾
C. 肺
D. 肝
E. 肾

正确答案：D。肝

解析：筋依赖肝血和肝气的濡养。肝之经气，布散至筋，以充养筋膜，若肝之气血不足，可导致筋脉失养，出现动作迟缓，屈伸不利的临床表现。所以“肝为五脏之贼”、“罢极之本”（D对）。心（A错）为“君主之官”、“生之本”“五脏六腑之大主”。脾（B错）为“后天之本”、“气血生化之源”。肺（C错）为“娇脏”、“华盖”、“相傅之官”。肾（E错）为“封藏之本”。